DNA是
A. 脱氧核糖核苷
B. 脱氧核糖核酸
C. 核糖核酸
D. 脱氧核糖核苷酸
E. 核糖核苷酸

正确答案：B。脱氧核糖核酸

解析：本题考查DNA。核酸分为脱氧核糖核酸（B对）（DNA）和核糖核酸（RNA）两类。